下列哪项不是与疾病发生有关的外环境
A. 气候因素
B. 地域因素
C. 生活环境
D. 工作场所
E. 外界精神刺激

正确答案：E。外界精神刺激

解析：影响疾病的因素除正气与邪气对发病的直接影响外，其他因素对防病的影响可归纳为环境因素、体质因素和精神状态三个方面。外环境是指人类生存的自然环境和社会环境（D对），主要包括气候变化（A对）、地域因素（B对）、生活工作环境（C对）。而外界精神刺激常能导致正气不足，进而内生诸邪（E错，为本题正确答案）。